参芪降糖胶囊与养胃舒胶囊的共同功能有
A. 健脾
B. 补肾
C. 益气
D. 养阴
E. 行气导滞

正确答案：A、C、D。健脾；益气；养阴

解析：本题考查的是参芪降糖胶囊与养胃舒胶囊的功能。参芪降糖胶囊与养胃舒胶囊的共同功能有健脾（A对）、益气（C对）与养阴（D对）。参芪降糖胶囊：【功能】益气养阴，健脾补肾（B错）。养胃舒胶囊：【功能】益气养阴，健脾和胃，行气导滞（E错）。